计数椎骨序数的标志
A. 枢椎齿突
B. 隆椎棘突
C. 胸骨角
D. 颈动脉结节
E. 肩胛下角

正确答案：B。隆椎棘突

解析：隆椎活体易于触及，常作为计数椎骨序数的标志（B对）。胸骨角（C错）、肩胛下角（E错）为计数肋的标志。